用于防止汞蒸汽中毒的防毒面具所用的防毒滤料是
A. 活性炭
B. 钠碳
C. 硫酸铜
D. “霍布卡”
E. 含碘活性炭

正确答案：E。含碘活性炭

解析：本题考查常用防毒滤料及其防护对象。防护对象为有机化合物蒸气时，滤料选用活性炭（A错）材质；防护对象为酸雾时，滤料选用钠碳（B错）材质；防护对象为氨时，滤料选用硫酸铜（C错）材质；防护对象为一氧化碳时，滤料选用“霍布卡”（D错）材质；防护对象为汞时，滤料选用含碘活性炭（E对）材质。